根据《中华人民共和国药品管理法实施条例》，关于药品的包装管理的说法，正确的是
A. 对不合格的直接接触药品包装材料的容器，由省级工商管理部门责令停止使用
B. 药品生产企业不得使用未经批准的直接接触药品的包装材料和容器
C. 直接接触药品的包装材料和容器，应在药品批准后，再报批
D. 药品包装必须按规定印有彩色醒目标签
E. 特殊管理药品、外用药、非处方药、药用辅料标签必须印有专有标识

正确答案：B。药品生产企业不得使用未经批准的直接接触药品的包装材料和容器

解析：本题考查药品包装的分类。根据《中华人民共和国药品管理法实施条例》，关于药品的包装管理的说法，正确的是药品生产企业不得使用未经批准的直接接触药品的包装材料和容器（B对）。药品包装的分类：药品的包装分内包装、外包装和最小销售单元包装。（1）内包装：系指直接与药品接触的包装（如安瓿、注射剂瓶、铝箔等，也叫做“药包材”）。药包材应当能保证药品在生产、运输、贮藏及使用过程中的质量，并便于医疗使用。《药品管理法》第四十六条规定，直接接触药品的包装材料和容器，应当符合药用要求，符合保障人体健康、安全的标准。对不合格的直接接触药品的包装材料和容器，由药品监督管理部门责令停止使用（A错）。国家对直接接触药品的包装有严格的规定和标准，如《药品包装材料与药物相容性试验指导原则》（YBB00142002）等相关技术指导原则的要求。2004年7月，国家药品监督管理部门发布《直接接触药品的包装材料和容器管理办法》（局令第13号），要求根据药品的性质选用药包材的材质，开展稳定性试验，考察药包材与药品的相容性；并要求制定注册药包材产品目录，并对目录中的产品实行注册管理。《药品管理法》第二十五条第二款规定，国务院药品监督管理部门在审批药品时，对化学原料药一并审评审批，对相关辅料、直接接触药品的包装材料和容器一并审评（C错），对药品的质量标准、生产工艺、标签和说明书一并核准。禁止使用未按照规定审评、审批的原料药、包装材料和容器生产药品。（2）外包装：系指内包装以外的包装，按由里向外分为中包装和大包装。外包装应根据药品的特性选用不易破损的包装，以保证药品在运输、贮藏、使用过程中的质量。（3）最小销售单元包装：实际上也是属于外包装，药品的每个最小销售单元的包装必须按照规定印有或贴有标签并附有说明书。《药品管理法》第四十九条规定，药品包装应当按照规定印有或者贴有标签并附有说明书。标签或者说明书应当注明药品的通用名称、成分、规格、上市许可持有人及其地址、生产企业及其地址、批准文号、产品批号、生产日期、有效期、适应症或者功能主治、用法、用量、禁忌、不良反应和注意事项。标签、说明书中的文字应当清晰，生产日期、有效期等事项应当显著标注，容易辨识（D错）。麻醉药品、精神药品、医疗用毒性药品、放射性药品、外用药品和非处方药的标签、说明书，应当印有规定的标志（E错）。